塑料牙与瓷牙比较，正确的说法是
A. 塑料牙质轻，咀嚼效能高
B. 瓷牙耐磨，但咀嚼效能低
C. 瓷牙和塑料基托结合好，但易崩裂
D. 塑料牙调（牙合）方便
E. 塑料牙不易变色

正确答案：D。塑料牙调（牙合）方便

解析：本题考查塑料牙与瓷牙的比较。塑料牙调（牙合）比较方便（D对），瓷牙调（牙合）容易出现崩瓷。塑料牙质轻，但咀嚼效能低（A错）。瓷牙耐磨，因此咀嚼效能高（B错）。塑料牙与基托结合好，瓷牙容易崩裂（C错）。塑料牙容易变色，瓷牙相对比较稳定，不容易变色（E错）。